循证药物信息（EBDI）指的是
A. 多年来医药学专家临床用药证明有效的DI
B. 多中心、大样本、随机、双盲、对照试验得到的DI
C. 对药物疗效作出客观评估，且有充足证据的DI
D. 用计算机实现高效、准确数理统计得到的DI
E. 世界各国传统医药学证明有效的DI

正确答案：B、C、D。多中心、大样本、随机、双盲、对照试验得到的DI；对药物疗效作出客观评估，且有充足证据的DI；用计算机实现高效、准确数理统计得到的DI